依据《中华人民共和国药品管理法》的规定，不得在市场销售的是
A. 未实施批准文号管理的中药材
B. 医院制剂
C. 预防性生物制品
D. 新发现和从国外引种的药材
E. 中药饮片

正确答案：B。医院制剂

解析：本题考查医疗机构制剂。依据《中华人民共和国药品管理法》的规定不得在市场销售的是医疗机构配制的制剂（B对）。医疗机构制剂是指医疗机构根据本单位临床需要经批准而配制、自用的固定处方制剂。医疗机构制剂具有如下特征：①双证管理。医疗机构获得《医疗机构制剂许可证》后，取得配制制剂的资格；如果要进行某种制剂的配制，还必须取得相应制剂的批准文号（法律对配制中药制剂另有规定的除外）。②品种补缺。医疗机构制剂仅限于临床需要而市场上没有供应的品种，方便临床使用。③医院自用为主。医疗机构制剂凭执业医师或者执业助理医师的处方在本单位内部使用，并与《医疗机构执业许可证》所载明的诊疗范围一致。医疗机构配制的制剂不得在市场上销售，不得发布医疗机构制剂广告。特殊情况下，经国务院药品监督管理部门或者省级药品监督管理部门批准，可在指定的医疗机构之间调剂使用。④药剂科自制。医疗机构制剂只能由医院的药学部门配制，其他科室不得配制供应制剂。⑤质量检验合格。医疗机构制剂需按规定进行质量检验，质量检验一般由医疗机构的药检室负责，检验合格后，凭医师处方使用。